属于左向右分流的先天性心脏病是
A. 二尖瓣关闭不全
B. 室间隔缺损
C. 肺动脉瓣狭窄
D. 主动脉缩窄
E. 右位心

正确答案：B。室间隔缺损

解析：左向右分流型，又称潜伏紫绀型，因为在左、右心之间或主动脉与肺动脉之间具有异常通路，平时主动脉压力高于肺动脉压力，血液从左向右分流而不出现紫绀。当用力啼哭、屏气、肺炎或任何病理情况使肺动脉或右心室压力增高并超过左心压力时，则可使血液自右向左分流而出现暂时性紫绀，属于此型的有室间隔缺损（B对）、房间隔缺损和动脉导管未闭等。二尖瓣关闭不全（A错）可见于风湿性或退行性心瓣膜病、二尖瓣脱垂、急性风湿热或运动、发热、贫血等症。肺动脉瓣狭窄（C错）和主动脉缩窄（D错）属于无分流型。右位心（E错）是心脏在胸腔的位置移至右侧的总称，不属于左向右分流的先天性心脏病。